在下列研究类型中，指导临床实践或公共卫生干预，证据效力最高的研究是
A. 传统综述
B. 系统综述
C. 实验研究
D. 实验研究的meta分析
E. 分子流行病学研究的meta分析

正确答案：D。实验研究的meta分析

解析：本题考查meta分析的相关内容。在实验研究的meta分析（D对ABCE错）的过程中，除了获得多项研究的综合结果外，还可以提高统计效能，加强主要结论的说服力，尤其是对样本量较小的临床试验研究。